引起心室肌细胞动作电位0期除极的主要离子是
A. Na⁺
B. Cl⁻
C. Ca²⁺
D. K⁺
E. Mg²⁺

正确答案：A。Na⁺